浆细胞主要存在于
A. 胸腺
B. 外周血
C. 脾及淋巴结
D. 黏膜相关的淋巴细胞
E. 骨髓

正确答案：C。脾及淋巴结